38岁初产妇，在家中经阴道自然分娩，当胎儿及胎盘娩出后，出现时多时少的阴道持续流血已1小时，送来急诊。为明确诊断，需追问对本病有价值的病史是
A. 贫血
B. 滞产
C. 高龄初产妇
D. 臀先露经阴道分娩
E. 新生儿体重3200g

正确答案：B。滞产

解析：青年初产妇，胎儿及胎盘娩出后，出现时多时少的阴道持续流血已1小时（宫缩乏力性出血，表现为胎盘娩出后，阴道间歇性的出血），考虑子宫收缩乏力引起的产后出血，宫缩乏力的原因可为产程产程延长使体力消耗过多，即滞产（B对）。贫血（A错）和高龄初产妇（C错）不是造成产后出血的病因。臀先露经阴道分娩（D错）可能导致软产道损伤，胎儿娩出后立即出现阴道流血，色鲜红，与本题条件不符。新生儿体重3200g（正常为2800～4000g）（E错），为正常水平，不会导致产后出血。